25岁初孕妇，末次月经2000年3月10日。于2000年10月13日就诊，检查宫底在脐上2横指，枕右前位，胎心率正常。现在应是
A. 妊娠满30周，宫底高度符合正常情况
B. 妊娠满30周，宫底高度低于正常
C. 妊娠满31周，宫底高度符合正常情况
D. 妊娠满31周，宫底高度低于正常
E. 妊娠满32周，宫底高度低于正常

正确答案：D。妊娠满31周，宫底高度低于正常

解析：该孕妇末次月经2000年3月10日，就诊日期为2000年10月13日，故妊娠时间为21+30×3+31×3+13=217天，即妊娠刚好满31周。正常情况下，妊娠28周末宫底高度为脐上3横指，妊娠32周末宫底高度为脐与剑突之间。该孕妇妊娠31周末，宫底在脐上2横指，应诊断为宫底高度低于正常（D对）。